整条肽链中全部氨基酸残基的相对空间位置即是
A. 蛋白质一级结构
B. 蛋白质二级结构
C. 蛋白质三级结构
D. 蛋白质四级结构
E. 单个亚基结构

正确答案：C。蛋白质三级结构